接种单位接种疫苗，应当遵守以下规定，但不包括
A. 预防接种工作规范
B. 预防接种免疫程序
C. 疫苗使用指导原则和接种方案
D. 公示第一类疫苗的品种和接种方法
E. 公示所有疫苗的品种和接种方法

正确答案：E。公示所有疫苗的品种和接种方法